医务人员的共同义务和天职是
A. 彼此平等，相互尊重
B. 彼此独立，相互支持和帮助
C. 彼此信任，相互协作和监督
D. 共同维护病人的利益和社会公益
E. 相互学习，共同提高和发挥优势

正确答案：D。共同维护病人的利益和社会公益

解析：大公无私是医德境界的最高层次，其主要特点是：医务人员把有利于病人、集体和社会作为职业行为准则，自觉坚持，持之以恒；凡事先为病人、集体和社会着想，把共同维护病人的利益和社会公益（D对）作为自己的天职。彼此平等，相互尊重（A错）；彼此独立，相互支持和帮助（B错）；彼此信任，相互协作和监督（C错）；相互学习，共同提高和发挥优势（E错）均为正确处理医务人员之间关系的道德原则。